根据中医望诊理论，胃火可见
A. 齿稀根露
B. 齿龈红肿
C. 齿龈青紫
D. 齿龈淡白
E. 牙齿蛀蚀

正确答案：B。齿龈红肿

解析：本题考查的是望龈的临床意义。根据中医望诊理论，胃火可见齿龈红肿（B对）。望龈：以观察牙龈的颜色及形态的变化为主。胃之经脉络于龈中，龈色淡白者（D错），多是血虚不荣；红肿者，多属胃火上炎；牙龈出血而红肿者，为胃火伤络；不红而微肿者，或为气虚，或为虚火伤络。望齿：以观察牙齿的色泽、润燥、形态几个方面。齿乃骨之余，骨为肾所主。如牙齿干燥，多是胃热炽盛、津液大伤；干燥如枯骨，多为肾精枯竭，肾水不能上承所致；牙齿松动稀疏、齿根外露（A错）者，多属肾虚或虚火上炎；睡中咬牙或啮齿，常见于胃中有热或虫积的患者。齿龈青紫（C错）、牙齿蛀蚀（E错）的临床意义，2022年考试指南未明确说明。